结核性胸膜炎的X线片表现是
A. 大叶性密度均匀突变阴影，逐渐溶解呈虫蚀样空洞
B. 小片状或斑点状阴影，可融合和形成空洞
C. 纤维厚壁空洞、肺门抬高和肺纹理呈垂柳样
D. 空洞形态不一，可呈多个空腔的虫蚀样空洞
E. 向外、向上的弧形影

正确答案：E。向外、向上的弧形影